抑制细菌依赖DNA的RNA聚合酶（DDRP）的药物是
A. 环丙沙星
B. 氟康唑
C. 异烟肼
D. 阿昔洛韦
E. 利福平

正确答案：E。利福平

解析：本题考查利福平的作用机制。抑制细菌依赖DNA的RNA聚合酶（DDRP）的药物是利福平（E对）。利福平的作用机制：抑制病原体依赖DNA的RNA聚合酶，与敏感菌依赖DNA的RNA聚合酶β亚单位牢固结合，抑制病原体RNA合成的起始阶段，抑制细菌RNA的合成。环丙沙星（A错）的作用机制：喹诺酮类药物抗革兰阴性菌的主要机制是抑制细菌的DNA回旋酶，从而干扰细菌的DNA复制。氟康唑（B错）的作用机制：氟康唑为唑类抗真菌药，可高度选择性干扰真菌的细胞色素P-450的活性，从而抑制真菌细胞膜上麦角固醇的生物合成。异烟肼（C错）的作用机制：异烟肼与菌体的β-酮脂酰载体蛋白合成酶形成复合体，抑制分枝杆菌细胞壁特有的重要成分分枝菌酸的合成，损害了细胞壁的结构完整性和对菌体的屏障保护作用，引起结核分枝杆菌死亡。还可通过抑制结核分枝杆菌的DNA合成或抑制菌体的某些酶，引起菌体代谢紊乱而死亡。阿昔洛韦（D错）的作用机制：阿昔洛韦属人工合成的鸟嘌呤核苷类似物，能选择性地抑制病毒DNA聚合酶。